多灶萎缩性胃炎的萎缩改变主要位于
A. 胃窦
B. 胃体
C. 胃底
D. 胃大弯
E. 胃小弯

正确答案：A。胃窦